残留有机氯农药最多的食品是
A. 肉鱼类
B. 蔬菜
C. 水果
D. 粮谷类
E. 豆类

正确答案：A。肉鱼类